患者，女，30岁。有风湿性关节炎病史。检查：心尖部可听到4级收缩期杂音，X线显示左心房、左心室增大。应首先考虑的心瓣膜病变是
A. 二尖瓣关闭不全
B. 二尖瓣狭窄
C. 主动脉瓣关闭不全
D. 主动脉瓣狭窄
E. 肺动脉瓣狭窄

正确答案：A。二尖瓣关闭不全

解析：患者青年女性，有风湿性关节炎病史（提示有风湿炎症病史），检查：心尖部可听到4级收缩期杂音（二尖瓣关闭不全的典型杂音），X线显示左心房、左心室增大（二尖瓣关闭不全的常见X线表现），综合患者的病史、查体和影像学检查，应首先考虑的心瓣膜病变是二尖瓣关闭不全（A对）。二尖瓣狭窄（P300）（B错）特征性的杂音为心尖区舒张期中晚期低调的隆隆样杂音,左心室增大少见。主动脉瓣关闭不全（P311）（C错）的典型杂音舒张期高调递减型叹气样杂音。主动脉瓣狭窄（P308）（D错）的典型杂音为收缩期粗糙而响亮的射流性杂音，呈递增-递减型，向颈部传导，在胸骨右缘1～2肋间听诊最清楚。肺动脉瓣狭窄（P289）（E错）典型的心脏杂音为胸骨左缘第二肋间响亮的收缩期喷射样杂音。